不能用于检测抗病毒抗体的方法是
A. ELISA
B. 中和试验
C. 红细胞凝集试验
D. 血凝抑制试验
E. 补体结合试验

正确答案：C。红细胞凝集试验

解析：常用的血清学方法有传统的中和试验、补体结合试验、血凝抑制试验等方法，和应用免疫学标记技术发展的酶联免疫吸附试验（ELISA）、放射免疫试验（RIA）及免疫荧光试验（IF）等特异、灵敏的微量血清学方法。而红细胞凝集试验（血凝试验）可半定量检测病毒颗粒的含量，不能检测出病毒抗体。掌握“病毒感染检查方法及防治原则”知识点。